玫瑰红染色试验可用于
A. 口腔癌
B. 牙石检查
C. 慢性腮腺炎
D. 舍格伦综合征
E. 口腔癌前病变

正确答案：D。舍格伦综合征

解析：本题考查舍格伦综合征的诊断。玫瑰红染色试验可用于舍格伦综合征（D对）。四碘四氯荧光素染色又称玫瑰红染色，用1滴1%四碘四氯荧光素滴入眼结膜囊内，随即以生理盐水冲洗，可在暴露的睑裂角膜部位发现鲜红的染色，是角膜上皮干燥状态的典型表现。舍格伦综合征会有眼部症状。